穿过眶上裂的结构为
A. 视神经
B. 动眼神经
C. 舌下神经
D. 下颌神经
E. 无

正确答案：B。动眼神经

解析：视神经（A错）向后内行经视神经管入颅中窝，移行于间脑的视交叉。动眼神经（B对）进于海绵窦外侧壁上部，穿眶上裂入眶。舌下神经（C错）在延髓锥体与橄榄体之间出脑，经舌下神经管出颅。下颌神经（D错）经卵圆孔出颅后分为数支。